儿童多发性抽动症肝亢风动证首选方剂是
A. 天麻钩藤饮
B. 礞石滚痰丸加减
C. 醒脾散加减
D. 知柏地黄汤
E. 大定风珠加减

正确答案：A。天麻钩藤饮

解析：若情志失调，气机不畅，可化火生风而致肝亢风动。因风盛生痰，风痰鼓动，上犯清窍，流窜经络，则见眨眼、摇头、耸肩、秽语、肢体抽动。本证以抽动频繁有力，面部抽动明显，烦躁易怒为临床特征，所以宜用具有清肝泻火，息风镇惊的天麻钩藤饮（A对）；礞石滚痰丸具有降火逐痰之功效，用于治疗痰火扰心所致的癫狂惊悸，或喘咳痰稠、大便秘结（B错）；醒脾散具有调理脾胃，用于治疗婴孩、小儿吐泻不止，脾困昏沉，默默不食（C错）；知柏地黄汤具有养阴清热，疏通尿道之功效。主治阴虚火盛，下焦湿热等证，症见面色潮红，两额发赤，精神空虚，食欲不佳，呼吸气促，语音细弱，夜间发热，盗汗失眠，耳鸣腰痛，头晕眼花，大便秘结。自从产后不久，忽然小便闭塞不通，小腹中胀满疼痛。唇色焦红，舌绛无苔，脉沉细数（D错）；大定风珠具有滋阴潜阳，柔肝息风的功效，用于治疗阴虚风动证，症见耸肩摇头，肢体震颤，筋脉拘急，咽干清嗓，挤眉眨眼，性情急躁，口出秽语，睡眠不安，形体消瘦，五心烦热，大便干结，舌质红绛，舌苔光剥，脉细数无力（E错）。